5岁小儿每日每公斤所需总热量是
A. 85kcal
B. 460kJ（110kcal）
C. 500kJ（120kal）
D. 540kJ（130kcal）
E. 580kJ（140kcal）

正确答案：A。85kcal

解析：婴儿每日所需能量为100kcal/kg，根据图5-1可知，5岁小儿每日每公斤所需总热量大约为85kcal/kg（A对）。